关于文化与健康的说法，以下正确的是
A. 良好的生活习惯与教育水平无关
B. 宗教信仰对人们的健康有益无害
C. 教育影响人们对生活方式的选择
D. 风俗习惯一般都会危害健康
E. 文化对健康的影响仅限于个体

正确答案：C。教育影响人们对生活方式的选择